中药炮制的目的是
A. 便于检识
B. 消除或降低毒副作用
C. 便于有效成分煎出，提高疗效
D. 便于制剂和服用
E. 改变药性

正确答案：B、C、D、E。消除或降低毒副作用；便于有效成分煎出，提高疗效；便于制剂和服用；改变药性

解析：本题考查的是中药炮制的目的。中药炮制的目的是消除或降低毒副作用（B对）、便于有效成分煎出，提高疗效（C对）、便于制剂和服用（D对）与改变药性（E对）。中药炮制的目的有：1.降低或消除药物的毒性或副作用；2.改变或缓和药物的性能；3.增强药物疗效；4.便于调剂和制剂；5.提高中药净度，确保用药质量和剂量。